治疗心神不安，惊悸失眠，应首选的药物是
A. 刺蒺藜
B. 石决明
C. 羚羊角
D. 钩藤
E. 牡蛎

正确答案：E。牡蛎

解析：牡蛎具有重镇安神，平肝潜阳，软坚散结，收敛固涩的功效，可用于心神不安，惊悸失眠，本品质重能镇，有安神之功效（E对）。刺蒺藜可用于肝阳上亢，头晕目眩；胸胁胀痛，乳闭胀痛；风热上攻，目赤翳障；风疹瘙痒、白癜风（A错）。石决明用于肝阳上亢，头晕目眩；目赤翳障，视物昏花；煅石决明还有收敛、制酸、止痛、止血的作用（B错）。羚羊角可用于肝凤内动，惊痫抽搐；肝阳上亢，头晕目眩；肝火上炎，目赤头痛；温热病壮热抻昏，热毒发斑（C错）。钩藤可用于头痛，眩晕；肝凤内动，惊痫抽搐；此外，其能清热透邪，故又可用于外感风热，头痛目赤及斑瘆透 发不畅之证（D错）。